以下关于结核病说法错误的是
A. 结核分枝杆菌通过呼吸道首次侵入人体为原发感染
B. 原发感染的结核菌沿淋巴管进入到血液中可导致血行播散
C. 机体感染结核分枝杆菌后是否发病受到细菌毒力、侵入机体的菌量以及机体自身免疫力的影响
D. 肺结核潜隐感染者虽无结核病的临床表现，但会传播结核病
E. 婴幼儿容易发生活动性结核病

正确答案：D。肺结核潜隐感染者虽无结核病的临床表现，但会传播结核病